下列哪个腧穴被首选治疗肩臂痛，臂不能举
A. 条口
B. 肩贞
C. 肩髃
D. 肩前
E. 外关

正确答案：D。肩前

解析：肩臂痛，臂不能举首选肩前（D对）；条口（A错）主治下肢痿痹，转筋，肩臂痛，脘腹疼痛；肩贞（B错）主治肩臂疼痛，上肢不遂，瘰疬；肩髃（C错）主治肩臂挛痛、上肢不遂等肩、上肢病证瘾疹；外关（E错）主治热病，头痛、目赤肿痛、耳鸣、耳聋等头面五官病证，瘰疬，胁肋痛，上肢痿痹不遂。